使生物碱碱性减小的吸电子基团有
A. 烷基
B. 羰基
C. 醚基
D. 酯基
E. 苯基

正确答案：B、C、D、E。羰基；醚基；酯基；苯基

解析：本题考查的是生物碱碱性强弱与分子结构的关系。使生物碱碱性减小的吸电子基团有羰基（B对）、醚基（C对）、酯基（D对）与苯基（E对）。诱导效应：生物碱分子中氮原子上的电子云密度受氮原子附近供电子基（如烷基（A错））和吸电子基（如各类含氧基团、双键、苯基等）诱导效应的影响。供电子诱导效应使氮原子上电子云密度增加，碱性增强；吸电子诱导效应使氮原子上电子云密度减小，碱性减弱。